治疗急性肝衰竭，下列措施中不合理的是
A. 口服乳果糖
B. 投予肠道抗菌药
C. 投予支链氨基酸
D. 投予脂肪乳剂以供给热量
E. 通过活性碳吸附，半透膜透析清除血中有害物质

正确答案：D。投予脂肪乳剂以供给热量

解析：急性肝衰竭的治疗包括：口服乳果糖（A对），促进体内氨的排出，防治肝性脑病（P413）；口服肠道抗菌药（B对），可抑制肠道产尿素酶的细菌，减少氨的生成；推荐肠内营养，包括高碳水化合物、低脂（D错，为本题正确答案）、适量蛋白饮食（肝性脑病患者需限制蛋白饮食）；酌情使用支链氨基酸（C对），减少假性神经递质的形成；通过活性碳吸附，半透膜透析清除血中有害物质（人工肝支持治疗）（E对），为肝移植作准备（2012年肝衰竭诊治指南）。